颅内压增高的三大主征是
A. 头痛、视力下降、恶心
B. 头痛、偏瘫、抽搐
C. 偏瘫、偏盲、偏身感觉障碍
D. 血压升高、脉博变快、呼吸变快
E. 头痛、呕吐、视神经乳头水肿

正确答案：E。头痛、呕吐、视神经乳头水肿

解析：颅内压增高的三大主征是头痛、呕吐、视神经乳头水肿（E对）。颅内压增高不能及时解除，压力向前传导，压迫视神经及视网膜中央动静脉，导致视力下降；恶心可见于颅内压增高的患者，但不是颅内压增高的主要体征（A错）。颅内压增高一般无偏瘫、抽搐（B错）症状。血压升高、心跳和脉搏缓慢、呼吸节律减慢（D错），称为库欣反应（P179），多见于急性颅内压增高者，慢性颅内压增高者不明显。偏瘫、偏盲、偏身感觉障碍（C错）称为“三偏征”，是内囊部位病变的主要体征，常见于内囊出血。